脊髓被膜间隙的描述何者错误
A. 蛛网膜下腔位于蛛网膜与软膜之间
B. 硬膜外腔位于硬膜与蛛网膜之间
C. 蛛网膜下腔在脊髓末端下方扩大形成终池
D. 以上都对
E. 以上都不对

正确答案：B。硬膜外腔位于硬膜与蛛网膜之间

解析：蛛网膜下腔位于脊髓蛛网膜与软脊膜之间（A对）。硬膜外腔位于硬脊膜与椎管内面的骨膜之间（B错，为本题正确选项）。脊髓蛛网膜下隙的下部，自脊髓下端至第2骶椎之间扩大的蛛网膜下隙，称终池（C对）。